下列单位或个人只有取得卫生许可证，才能从事食品生产经营活动，但不包括
A. 食品厂
B. 方便面厂
C. 职工食品
D. 食品个体摊贩
E. 药房

正确答案：E。药房